可引起ST段弓背向下抬高的疾病是
A. 急性心肌梗死
B. 心绞痛
C. 急性心包炎
D. 主动脉夹层动脉瘤
E. 室壁瘤

正确答案：C。急性心包炎

解析：急性心包炎ST段呈弓背向下抬高（C对）。引起心电图ST段上抬超过正常范围且弓背向上的疾病是急性心肌梗死（A错）。典型心绞痛发作时面对缺血区的导联上出现 ST段下移，可呈水平型或下斜型压低≥0.1 mV，或在原有的基础上进一步下移达0.1 mV以上（B错）。主动脉夹层动脉瘤可示左心室肥大，非特异性ST-T改变（D错）。心电图持续抬高达6个月以上提示心室室壁瘤（E错）。